评价幼儿园儿童的智力发育水平或诊断智力低下的重要方法是
A. 贝利婴幼儿发育量表
B. 韦氏学龄前儿童智力量表
C. 发育量表
D. 韦氏儿童智力量表
E. 图片词汇测验

正确答案：B。韦氏学龄前儿童智力量表

解析：本题考查神经心理发育各年龄段的测评方法。评价幼儿园儿童的智力发育水平或诊断智力低下的重要方法是韦氏学龄前儿童智力量表（B对），其适用于2岁6个月～7岁3月幼儿的智力测量。贝利婴幼儿智力发育量表（A错）适用的年龄范围是两个月到30个月的婴儿。发育量表（C错）主要评价中枢神经系统的功能：识别神经肌肉或感觉系统是否有缺陷，发现存在的可以治疗的发育异常，对高危儿发现他们的行为随后的变化，对孤独症、发育迟缓具有诊断价值。韦氏儿童智力量表（D错）评估6岁至16岁儿童智力水平的智力测验工具。图片词汇测验（E错）是一套为发声有困难的人及聋人设计的测量其“使用”词汇能力的测验工具。